女，23岁。G₀P₀。右下腹隐痛半个月，加重5小时。月经不规律，查体：T37.0℃，P96次/分，R23次/分，BP105/75mmHg。妇科检查：子宫右旁可触及大小约6cm的实性包块，触痛，子宫及左侧附件未触及异常。血清AFP900μg/t。该患者最可能的诊断是
A. 卵巢上皮性肿瘤
B. 卵巢支持细胞-间质细胞瘤
C. 卵巢颗粒细胞瘤
D. 卵巢无性细胞瘤
E. 卵巢卵黄囊瘤

正确答案：E。卵巢卵黄囊瘤

解析：患者年轻女性，G₀P₀（卵巢卵黄囊瘤的好发人群）。右下腹隐痛半个月并加重，月经不规律（卵巢卵黄囊瘤的临床表现），妇科检查：子宫右旁可触及大小约6cm的实性包块，触痛，子宫及左侧附件未触及异常（卵巢肿瘤的检查体征）。血清AFP900μg/t（正常值为0～25ug/L，卵巢卵黄囊瘤的诊断及病情监测的重要标志物）。根据患者的病史、临床表现和辅助检查，可初步考虑诊断为卵巢卵黄囊瘤（E对）。卵巢上皮性肿瘤（A错）（P326）为最常见的组织学类型，多见于中老年妇女；卵巢无性细胞瘤（D错）（P329）好发于青春期女性，单侧居多，圆形或椭圆形，放疗敏感；卵巢颗粒细胞瘤（C错）（P330）成年型多见于45～55岁，能分泌雌激素，幼年型主要发生在青少年。卵巢支持细胞-间质细胞瘤（B错）（P330）多发生在40岁以下妇女，可有男性化表现或雌激素升高，且以上均无血清AFP升高表现。